既滋阴养血，又补心安神的中成药是
A. 养血安神丸
B. 复方枣仁胶囊
C. 天王补心液
D. 枣仁安神颗粒
E. 人参珍珠口服液

正确答案：C。天王补心液